贴敷法可用于治疗的病证是
A. 外阴肿痛
B. 痛经
C. 阴道炎
D. 宫颈癌
E. 外阴炎

正确答案：A。外阴肿痛

解析：敷贴法将药物制成膏剂、散剂、糊剂等，直接敷贴于患处可起到解毒、消肿、止痛或拔脓生肌等作用，常用于外阴肿痛（A对）、盆腔炎性疾病及回乳等。冲洗法适用于阴道炎（C错）。坐浴或熏洗法适用于外阴炎（E错）。宫颈癌适用于手术治疗（D错）。热熨法适用于痛经（B错）。